一位发热患者，体温在39℃以上，未用任何退热降温措施，24小时内体温波动达2℃以上，最低时体温仍高于正常。这种热型是
A. 稽留热
B. 波浪热
C. 间歇热
D. 回归热
E. 弛张热

正确答案：E。弛张热

解析：患者体温在39℃以上，未用任何退热降温措施，4小时内体温波动达2℃以上，最低时体温仍高于正常，符合弛张热（体温常在39℃以上，波动幅度大，24小时内波动范围超过2℃，但都在正常水平以上）（E对）。稽留热（A错）是指体温恒定地维持在39～40℃以上的高水平，达数天或数周，24小时内体温波动范围不超过1℃。波浪热（B错）是指体温逐渐上升达39℃或以上，数天后又逐渐降至正常水平，持续数天后又逐渐升高，如此反复多次。间歇热（C错）是指体温骤升达高峰后持续数小时，又迅速降至正常水平，无热期（间歇期）可持续1天到数天，如此高热期与无热期反复交替出现。回归热（D错）是指体温急剧上升至39℃或以上，持续数天后骤然下降至正常水平，高热期与无热期各持续若干天后规律性交替一次。